独语、错语的共同病因是
A. 风痰阻络
B. 热扰心神
C. 痰湿阻络
D. 心气不足
E. 痰火扰心

正确答案：D。心气不足

解析：独语多因心气不足，心神失养，或气机郁滞痰气阻塞，痰浊蒙蔽心神所致。错语有虚实之分，虚证多因心气不足，心神失养，多见于久病体虚或老年脏气虚弱之人（D对）。风痰阻络（A错）导致患者语言謇涩，每与舌强并见。痰热扰乱心神（B错）可导致患者谵语。痰浊湿邪阻痹经络（C错），以肢体或关节等处肿胀、屈伸不利，或皮肤肿硬、麻木、瘙痒，苔白腻等为常见症状。情志不遂，气机郁滞化火，痰火互结，内扰神明（E错）导致狂言。